腹痛伴有呕吐，腹胀，停止排便排气的疾病是
A. 肠梗阻
B. 急性菌痢
C. 急性胆囊炎
D. 结核性腹膜炎
E. 急性腹腔内出血

正确答案：A。肠梗阻

解析：腹痛、呕吐、腹胀和停止排便排气为肠梗阻（A对）的典型临床表现。急性菌痢（B错）主要表现为腹痛、腹泻及粘液脓血便等；急性胆囊炎（C错）主要表现为上腹部疼痛，多由饱餐、进食肥腻食物所诱发，可伴恶心、呕吐、厌食、便秘等消化道症状；结核性腹膜炎（D错）主要表现为腹部压痛、腹肌紧张和反跳痛等腹膜炎体征，一般无肛门停止排便排气；急性腹腔内出血（E错）多见于腹部实质脏器损伤，主要表现为面色苍白、脉率加快、脉搏微弱、血压不稳，甚至休克，腹痛呈持续性，一般不剧烈，较少伴呕吐、停止排便排气。